流行性斑疹伤寒的传播媒介是
A. 蚊
B. 人虱
C. 鼠蚤
D. 恙螨
E. 蜱

正确答案：B。人虱

解析：流行性斑疹伤寒（虱传斑疹伤寒）的病原体是普氏立克次体，病人是普氏立克次体的储存宿主和传染源，人虱（体虱）（B对）是传播媒介。埃及伊蚊和白纹伊蚊（A错）是登革热的传播媒介（P282）。地方性斑疹伤寒（又称鼠型斑疹伤寒或蚤传斑疹伤寒）的病原体是莫氏立克次体，鼠蚤和鼠虱（C错）是主要传播媒介（P183表19-1）。恙螨（D错）是恙虫病东方体即恙虫病立克次体的传播媒介（P183表19-1）。硬蜱（E错）是莱姆病的主要传播媒介（P198表21-1）。